治疗盗汗阴虚火旺证，应首选
A. 玉屏风散
B. 六味地黄丸
C. 一贯煎
D. 当归六黄汤
E. 生脉散

正确答案：D。当归六黄汤

解析：当归六黄汤中当归养血，生地、熟地滋阴，黄芩、黄连、黄柏泻火清热，六药相合，热清则火不内扰，阴坚则汗不外泄。汗出过多，卫虚不固，故用黄芪益气实卫以固表，固未定之阴，且可合当归、熟地益气养血。诸药合用，共奏滋阴泻火，固表止汗之功。是治疗盗汗阴虚火旺的首选方（D对）。玉屏风散，其功用为益气固表止汗，可用于虚体感冒之表虚自汗，易伤风邪者（A错）。六味地黄丸，其功用为滋补肝肾，可用于下消之肾阴亏虚证(B错)。一贯煎，其功用为滋阴柔肝止痛，适用于胁痛之肝阴不足证，合芍药汤也可用于胃痛之胃阴不足证（C错）。生脉散，其功用为益气生津，敛阴止汗，适用于温热、暑热，耗气伤阴证及久咳伤肺，气阴两虚证（E错）。